女，45岁，无痛性肉眼血尿1个月，尿中偶有血块，伴膀胱刺激症状。B超见膀胱右侧壁有一个1cm×2cm软组织影，有蒂。为明确诊断，最有价值的检查方法是
A. 尿细胞学检查
B. 盆腔MRI
C. 盆腔CT
D. 膀胱造影
E. 膀胱镜检查+活检

正确答案：E。膀胱镜检查+活检

解析：中年女性患者，无痛性肉眼血尿、偶有血块（提示可能有泌尿系肿瘤），伴膀胱刺激症状，B超可见膀胱右侧壁有蒂软组织影（提示膀胱肿瘤），结合患者的临床表现和B超检查，应考虑的诊断是膀胱肿瘤。为确定肿物性质，最有价值的检查方法应为膀胱镜检查+活检（E对）。尿脱落细胞检查（A错）为泌尿系肿瘤常用的初步筛查方法，不能用于确诊膀胱癌。盆腔MRI（B错）和盆腔CT（C错）可发现肿瘤浸润膀胱深度、肿大的淋巴及内脏转移的情况，对膀胱癌的临床病理分期具有重要价值。膀胱造影（D错）可以提示膀胱内肿物的形态，但无法明确肿瘤的性质，不能确定诊断。